男性，35岁，汽车撞伤左季肋区4小时，神志模糊，体温37.5℃，脉搏细弱，血压60/40mmHg，全腹压痛，无反跳痛，无尿。首先考虑的诊断是
A. 神经源性休克
B. 感染性休克
C. 中度低血容量性休克
D. 重度低血容量性休克
E. 过敏性休克

正确答案：D。重度低血容量性休克

解析：患者左季肋区外伤史、全腹压痛、无反跳痛提示可能出现脾破裂、腹腔内出血，神志模糊、脉搏细弱、血压60/40mmHg，无尿提示出现重度休克（中度休克收缩压为90～70mmHg，重度休克收缩压在70mmHg以下或测不到），综合考虑其诊断应为重度低血容量性休克（D对C错）。本例患者没有感染史、过敏史及神经源性病因，因此不应诊断为神经源性休克（A错）、感染性休克（B错）、过敏性休克（E错）。